女孩，2岁，高热四天，温度39.0℃～39.8℃，使用青霉素治疗无效。查体：身上多形性红斑，手足指端硬性水肿，双眼球结膜充血，颈部淋巴结肿大，口咽部黏膜弥漫性充血，口唇干裂，舌乳头轮廓突出，血常规：WBC14×10⁹/L，N：0.84，L：0.2，血小板200×10⁹/L。对该病预后最有价值的检查
A. X线示心脏心影上部扩大
B. 超声心动图示冠状动脉扩大
C. 血沉速度快
D. 抗EBV-IgM抗体阳性
E. 抗角蛋白抗体谱

正确答案：B。超声心动图示冠状动脉扩大

解析：女孩，2岁，高热四天，温度39.0℃～39.8℃（发热），使用青霉素治疗无效，查体：身上多形性红斑（皮肤表现），手足指端硬性水肿（川崎病特征性手足表现），双眼球结膜充血，颈部淋巴结肿大，口咽部黏膜弥漫性充血，口唇干裂，舌乳头轮廓突出（口唇表现），符合川崎病诊断，超声心动图是本病最重要的辅助检查手段（B对）。